休克早期或代偿期成人首剂量输入晶体液和胶体液一般为
A. 500ml
B. 1000ml
C. 1500ml
D. 2000ml
E. 2500ml

正确答案：D。2000ml

解析：本题考查口腔颌面部创伤急救。休克早期或代偿期，应迅速建立输液通道，快速补充血容量，可输入晶体液和胶体液，成人首剂量一般为2000ml（D对）（小儿：20ml/kg）。1.休克早期或代偿期，应快速补充血容量，输入晶体液和胶体液，成人首剂量一般为2000ml(小儿20ml/kg)。2.中度休克者，则以输全血为主，适当补充其他液体，第1小时可输血1000ml左右。3.重度休克患者收缩压低于70mmHg的，要在10～30分钟内输全血1500ml，以后再根据需要调整输血、补液的量和速度。